45岁女性，上腭肿块3年，自述无症状性肿大，肉眼可见不规则肿块，固定不活动，界限清楚，质地中等。施行肿瘤摘除术时观察到剖面为灰白色，实性，有白色条纹，可见有透明黏液的囊腔和黄色角化物。则该肿瘤的镜下表现描述正确的一项是
A. 结构多形性，细胞多形性
B. 肿瘤上皮细胞形成大小和形态不一腺管样和囊腔样结构
C. 肿瘤细胞主要为充满嗜酸性颗粒的大嗜酸性粒细胞
D. 肿瘤细胞来自于闰管或闰管储备细胞
E. 肿瘤细胞使用磷钨酸苏木精染色呈阳性反应

正确答案：D。肿瘤细胞来自于闰管或闰管储备细胞

解析：本题考查多形性腺瘤。45岁女性，上腭肿块3年，自述无症状性肿大，肉眼可见不规则肿块，固定不活动，界限清楚，质地中等。施行肿瘤摘除术时观察到剖面为灰白色，实性，有白色条纹，可见有透明黏液的囊腔和黄色角化物。则该肿瘤的镜下表现描述正确的一项是肿瘤细胞来自于闰管或闰管储备细胞（D对）。根据患者的临床特点及检查时的体征可知为多形性腺瘤。其来自闰管或闰管储备细胞，它既可向上皮分化，又可向肌上皮细胞分化，肿瘤性肌上皮细胞进一步形成黏液软骨样组织，从而形成肿瘤的多形性结构。